有利于老年人健康的饮食原则，错误的是
A. 摄入尽量多的蛋白质
B. 多吃蔬菜、水果以增加维生素和膳食纤维的摄入
C. 脂肪的摄人以植物油为主
D. 碳水化合物以谷类为主，少吃精制糖
E. 经常吃豆类和鱼类食品

正确答案：A。摄入尽量多的蛋白质